下列关于结合胆红素性质的叙述错误的是
A. 直接与重氮试剂发生反应
B. 通过肾小球随尿排出
C. 是胆红素与葡萄糖醛酸结合的产物
D. 水溶性高
E. 容易透过细胞膜

正确答案：E。容易透过细胞膜

解析：结合胆红素：是胆红素与葡萄糖醛酸结合的产物（C对），又称直接胆红素，直接与重氮试剂发生反应（A对），水溶性高（D对），可通过肾小球随尿排出（B对），不容易透过细胞膜（E错，为本题正确答案）。